患儿，男，5岁，诊断为急性细菌性扁桃体炎，儿科医师处方阿莫西林颗粒，处方用纸颜色应为
A. 白色
B. 淡黄色
C. 淡绿色
D. 淡红色
E. 淡蓝色

正确答案：C。淡绿色

解析：本题考查处方的种类。儿科处方的印刷用纸为淡绿色（C对），右上角标注“儿科”。